瓦楞子、牡蛎、海螵蛸与四环素联用，能
A. 引发肾功能衰竭
B. 形成络合物
C. 产生永久性结合物
D. 引发永久性耳聋
E. 引发药源性肝病

正确答案：B。形成络合物

解析：本题考查的是中西药不合理联用产生的副作用。瓦楞子、牡蛎、海螵蛸与四环素联用，能形成络合物（B对）。含钙、镁、铁等金属离子的中药，如石膏、瓦楞子、牡蛎、龙骨、海螵蛸、石决明、赭石、明矾等及其中成药，不能与四环素类抗生素联用，因金属离子可与此类西药形成络合物，而不易被胃肠道吸收，降低疗效。引发肾功能衰竭（A错）为含乙醇的中成药与乙酰氨基酚联用的副作用。含乙醇的中成药如各种药酒等，不可与对乙酰氨基酚同服，因同用后二者的代谢产物对肝脏损害严重，有些患者对此类药极为敏感，从而可引起肝坏死及急性肾衰竭。产生永久性结合物（C错）为含鞣质较多的中药或中成药与维生素B₁或维生素K联用的效果。含鞣质较多的中药或中成药，不可与维生素B₁或维生素K合用，因合用后会在体内产生难以吸收的结合物，使药效降低。引发永久性耳聋（D错）为含碱性成分的中药及其制剂与氨基糖苷类西药合用的副作用。含碱性成分的中药及其制剂，不能与氨基糖苷类西药合用，因这些中药及其制剂能使机体对氨基糖苷类抗生素吸收增加，排泄减少，虽能提高抗生素的抗菌药力，但却增加了其在脑组织中的药物浓度，使耳毒性作用增强，从而影响前庭功能，导致暂时或永久性耳聋及行动蹒跚。引发药源性肝病（E错）为含水合型鞣质而对肝脏有一定毒性的中药及中成药与对肝脏有一定毒性的西药四环素、利福平、氯丙嗪、异烟肼、依托红霉素等联用的副作用。含水合型鞣质而对肝脏有一定毒性的诃子、五倍子、地榆、四季青等，以及含有这些药物的中成药，不能与对肝脏有一定毒性的西药四环素、利福平、氯丙嗪、异烟肼、依托红霉素等联用，因联用后会加重对肝脏的毒性，导致药源性肝病的发生。